肺痨的外在致病因素是
A. 燥邪
B. 瘵虫
C. 痰浊
D. 瘀血
E. 水饮

正确答案：B。瘵虫

解析：肺痨是自体正气虚弱之人感染痨虫而得，故瘵虫是本病外在致病因素（B对）。燥邪属外感六淫之一，引起表证证候，而肺痨属于内伤传染性疾病(A错)。肺痨，病理性质主要在阴虚，并可导致气阴两虚，甚则阴损及阳，病久可以出现痰浊、瘀血、水饮，但这些均属病理产物，不是致病因素（CDE错）。